神曲的功效特点是
A. 消食兼能散瘀
B. 消食兼能发表
C. 消食兼能疏肝
D. 消食兼能化石
E. 消食兼能化痰

正确答案：B。消食兼能发表

解析：神曲性味甘辛温，辛以行散消食，甘温健胃和中，故有消食和胃的功效；本品又略能解表退热，故尤宜治疗食滞兼外感表证者（B对）。